实时发布预警消息，协助群众做好应对准备属于突发公共卫生事件分期中的
A. 潜伏期
B. 暴发期
C. 打击期
D. 处理期
E. 恢复期

正确答案：A。潜伏期

解析：本题考查突发公共卫生事件的分期。潜伏期（A对BCDE错）是突发公共卫生事件发生前的前兆期或酝酿期。此期应立刻采取紧急应变措施，将可能受到影响的居民疏散到安全地方，保护即将受波及的设施，动员紧急救援人员待命，并实施发布预警信息，协助群众做好应对准备。